我国体力劳动强度分级标准制订的依据是
A. 能量代谢
B. 劳动时间率和心率
C. 肺通气量和心率
D. 能量代谢率和劳动时间率
E. 通气量和排汗量

正确答案：D。能量代谢率和劳动时间率